患者长期卧床，突发意识障碍，偏瘫，偏身感觉障碍应首先考虑的是
A. 脑栓塞
B. 脑血栓
C. 短暂性脑缺血性发作
D. 脑出血
E. 蛛网膜下腔出血

正确答案：A。脑栓塞

解析：患者长期卧床，突发意识障碍，偏瘫，偏身感觉障碍，是由于栓子形成，约4/5脑栓塞累及大脑中动脉主干及其分支，出现失语、偏瘫、单瘫、偏身感觉障碍和局限性癫痫发作等，偏瘫多以面部和上肢为重，下肢较轻（A对）。脑血栓完全性卒中指发病后神经功能缺失症状较重较完全，常于数小时内（＜6小时）达到高峰。病情一般较严重，出现完全性偏瘫，伴不同程度的意识障碍，甚至死亡（B错）。发病突然，迅速出现局限性神经功能或视网膜功能障碍，多于5分钟左右达到高峰，持续时间短，恢复快，不留后遗症，症状和体征应在24小时内完全消失；可反复发作，其临床表现虽因缺血脑组织的部位和范围不同而多样化，但就个体每次发作的症状相对较恒定，为雷同的刻板样症状，发作间歇期无神经系统定位体征（C错）。急性期常见的主要表现有头痛、头晕、呕吐、意识障碍、肢体瘫痪、失语、大小便失禁等（D错）。蛛网膜下腔出血最常见的症状是患者突然剧烈头痛、恶心、呕吐。可有局限性或全身性抽搐、短暂意识不清，甚至昏迷。少数患者可有精神症状、头昏、眩晕、颈背或下肢疼痛等（E错）。